舍格伦综合征口腔检查可发现
A. “镜面舌”
B. “沟纹舌”
C. “地图舌”
D. “黑毛舌”
E. “游走性舌炎”

正确答案：A。“镜面舌”

解析：口腔检查可见口腔黏膜干燥，口镜与口腔黏膜黏着而不能滑动。口底唾液池消失。唇舌黏膜发红，舌表面干燥并出现裂纹，舌背丝状乳头萎缩，舌表面光滑潮红呈“镜面舌”。部分患者出现口腔黏膜病，由于失去唾液的清洁、稀释及缓冲作用，龋病的发生率明显增加，且常为猛性龋。掌握“舍格伦综合征”知识点。